下列方剂，用法中有乌梅的是
A. 平胃散
B. 止嗽散
C. 清燥救肺汤
D. 玉液汤
E. 二陈汤

正确答案：E。二陈汤

解析：二陈汤中复用少许乌梅，收敛肺气，与半夏橘红相伍，散中兼收，防其燥散伤正之虞（E对）。趣记：陈夏领草莓酱—陈夏苓草梅姜。